颞下颌关节检查不包括
A. 下颌运动
B. 髁突
C. 淋巴结
D. 开口型
E. 外耳道

正确答案：C。淋巴结

解析：本题考查颞下颌关节检查。颞下颌关节检查不包括淋巴结（C错，为本题的正确答案）。下颌运动（A对）、髁突的运动（B对）、开口型（D对）以及外耳道的检查（E对）均属颞下颌关节的检查；淋巴结检查属于颈部检查，不属于颞下颌关节检查。